患者，女性，22岁，4天前因劳累出现左侧下后牙龈胀痛，进食吞咽时加重，昨日起出现局部自发性跳痛，面部肿胀，张口受限，伴发热。检查：左侧颊部肿胀，局部皮温增高，压痛明显，局限于咬肌前缘处，并及凹陷性水肿；张口度约二指，左下颌第三磨牙近中低位阻生，牙龈瓣覆盖其上，充血肿胀，并见糜烂，挤压局部少量脓液溢出，同侧第一磨牙前庭沟丰满充血，压痛存在，第一磨牙叩诊（-），无松动，无龋坏，未及牙周袋。该患者最有可能的诊断是：
A. 左侧第三磨牙冠周炎
B. 左侧第一磨牙牙槽脓肿
C. 左侧第一磨牙牙周脓肿
D. 左侧第三磨牙牙龈炎
E. 左下颌磨牙后区牙龈溃烂继发感染

正确答案：A。左侧第三磨牙冠周炎

解析：本题考查智齿冠周炎。智齿冠周炎（A对）常以急性炎症的形式出现，表现为磨牙后区局部胀痛，进食加重，病情继续发展，局部呈自发性跳痛，张口受限，触诊凹陷性水肿，有压痛，全身症状有发热、畏寒等，口腔局部检查可见智齿阻生，龈瓣边缘糜烂，继发感染局限化脓，形成冠周脓肿（E错）。急性牙槽脓肿（B错）即急性化脓性根尖周炎，临床表现为①自发性剧烈跳痛，伸长感加重，咬合痛，②叩痛明显且牙齿松动，根尖部牙龈潮红无明显肿胀，扪诊轻微疼痛，③下颌下淋巴结或颏下淋巴结肿大、压痛。牙周脓肿（C错）是牙周炎晚期常见伴发症状，急性牙周脓肿早期炎症水肿，患牙唇颊侧或舌腭侧牙龈形成椭圆形或半球状的肿胀突起，有搏动性疼痛，患牙“浮起感”，叩痛，松动明显；后期扪诊有波动感，脓肿可自行破溃，疼痛减轻。牙龈炎（D错）的炎症水肿型一般表现为龈缘红肿、光亮、松软、易出血；纤维增生型，一般病程较长，龈缘肿胀坚实，炎性增生。